可复性牙髓炎对下列哪项刺激最敏感
A. 冷、热刺激
B. 探诊
C. 触诊
D. 甜刺激
E. 酸刺激

正确答案：A。冷、热刺激

解析：本题考查可复性牙髓炎。可复性牙髓炎对冷、热刺激（A对）最敏感。可复性牙髓炎没有自发痛，对冷热刺激敏感，当刺激一去除，疼痛立即消失，无需触诊（C错）。牙本质敏感对酸甜（DE错）和机械刺激，如探诊（B错）较敏感。